肉桂与丁香共同的功效是
A. 散寒止痛，助阳
B. 助阳止呕
C. 温通经脉
D. 引火归原
E. 温中降逆

正确答案：A。散寒止痛，助阳

解析：肉桂味辛、甘、性大热，入肾、脾、心、肝经。辛甘热，为纯阳之品，主入下焦，以峻补命门之火，益阳消阴为主，且引火归原；辛散温通，入于血脉，能温气血，散寒滞，止疼痛。丁香味辛、性温，入脾、胃、肺、肾经。辛温，主入中焦，降胃气，止呕逆。且温肾助阳。可见二者共有散寒止痛，助阳的功效（A对）。